好发于颈正中线，以舌骨上下部为最常见的是
A. 含牙囊肿
B. 根端囊肿
C. 始基囊肿
D. 皮样囊肿
E. 甲状舌管囊肿

正确答案：E。甲状舌管囊肿

解析：甲状舌管囊肿可发生于颈正中线，自舌盲孔至胸骨切迹间的任何部位，但以舌骨上下部为最常见。掌握“牙源性颌骨囊肿”知识点。